评估呼吸气流是否受限最常用的指标是
A. 残气量/肺总量（RV/TLC）
B. FEV₁%预计值
C. 峰流速（PEF）
D. FEV₁/FVC
E. 用力肺活量（FVC）

正确答案：D。FEV₁/FVC

解析：1秒钟用力呼气容积（FEV₁）与用力肺活量（FVC）之比是判断气流受限的最重要指标（D对），FEV₁/FVC%＜70%可确定为持续气流受限。残气量与肺总量的比值增加提示阻塞性肺疾病（A错）。FEV₁%预计值（B错）是诊断气流受限严重程度的指标，对中晚期COPD的检查比较可靠。PEF又称呼气流量峰值（C错），是指用力肺活量测定过程中，呼气流量最快时的瞬间流速。用力肺活量（FVC）（E错）是指尽力最大吸气后，尽力尽快呼气所能呼出的最大气量，略小于没有时间限制条件下测得的肺活量，该指标是指将测定肺活量的气体用最快速呼出的能力，是测定呼吸道有无阻力的重要指标。